某心理咨询师，在某超级市场遇见一位他的患者也正与其熟人在一起购物，这位治疗师故意未理睬他的患者，因为他遵循的一个心理治疗的原则是
A. 真诚原则
B. 保密原则
C. 中立原则
D. 回避原则
E. 灵活原则

正确答案：B。保密原则